某小学有大批的学生发生不明原因的腹泻，为了寻找病因及流行的线索，通过第一步的研究，结果提示大批学生的腹泻可能与饮用了某厂生产的饮料有关，下一步最好采取
A. 病例对照研究
B. 临床试验研究
C. 现况调查研究
D. 理论流行病学研究
E. 队列研究

正确答案：A。病例对照研究

解析：病例对照研究用于判断暴露因素是否与研究的疾病有关联及其关联程度大小，应选择患有腹泻和未患腹泻的学生分别作为病例组和对照组，调查各组学生过去饮用了某厂生产的饮料的比例，通过比较各组之间暴露比例的差异，明确腹泻是否与某厂饮料有关（A对）。临床试验用于评价药物或治疗方法的效果（B错）。现况调查研究收集特定时间、特定人群中疾病、健康状况及有关因素的资料，并对资料的分布特征加以描述（C错），无助于明确腹泻是否与某厂饮料有关。理论流行病学用于客观定量地描述疾病流行状况或预测疾病流行趋势，从理论上探讨疾病的流行规律和防制措施的效果（D错），无助于明确腹泻是否与某厂饮料有关。队列研究是判定暴露因素与结局之间有无关联及关联程度大小（E错），无助于明确腹泻是否与某厂饮料有关。